下颌下颈部能触到多个广泛的淋巴结，见鼻出血，鼻有液体流出，诊断为
A. 根尖周炎
B. 溃疡
C. 冠周炎
D. 上颌窦癌
E. 上颌窦炎

正确答案：D。上颌窦癌

解析：本题考查恶性肿瘤。下颌下颈部能触到多个广泛的淋巴结，见鼻出血，鼻有液体流出，诊断为上颌窦癌（D对）。上颌窦癌为鼻窦鳞癌中的最常见者。上颌窦癌常转移至下颌下及颈上部淋巴结，有时可转移至耳前及咽后淋巴结。远处转移少见。根尖周炎（A错）、溃疡（B错）、冠周炎（C错）、上颌窦炎（E错）在下颌下颈部均未触及多个广泛的淋巴结。